苯妥英钠的特点有
A. 刺激性大，故不宜肌内注射
B. 口服吸收慢而不规则
C. 血浆药物浓度个体差异大
D. 血浆蛋白结合率高于80%
E. 主要以原形经尿排出

正确答案：A、B、C、D。刺激性大，故不宜肌内注射；口服吸收慢而不规则；血浆药物浓度个体差异大；血浆蛋白结合率高于80%